患者，11周岁，口腔检查时发现，刚萌出的左下5带有尖而长的畸形中央尖，则正确的处理为
A. 定期观察
B. 适当调改对颌牙，同时少量多次调磨此尖
C. 在麻醉和严格的消毒下，将此尖一次磨除，并常规行盖髓治疗
D. B和C
E. 行根尖诱导形成术

正确答案：D。B和C

解析：本题考查畸形中央尖的治疗。尖而长的畸形中央尖，易磨损和折裂影响咬合，不宜定期观察（A错），必须加以处理，正确的处理方法为适当调改对颌牙，同时少量多次调磨此尖（B对）；或在麻醉和严格的消毒下，将此尖一次磨除，并常规行盖髓治疗 （C对）（BC均对，故D为本题的正确答案）。畸形中央尖折断，可引起牙髓或根尖周病变时，为保存患牙和促进牙根继续发育完成，可采用根尖发育形成术或根尖诱导形成术，该患者牙尖尚未折断、尚未引起根尖周炎不需进行根尖诱导形成术（E错）。